医用脱脂棉和医用脱脂纱布属于
A. 第一类医疗器械产品
B. 第二类医疗器械产品
C. 第三类医疗器械产品
D. 第四类医疗器械产品
E. 第五类医疗器械产品

正确答案：B。第二类医疗器械产品

解析：本题考查的是医疗器械分类。医用脱脂棉和医用脱脂纱布属于第二类医疗器械产品（B对）。第一类（A错）是风险程度低，实行常规管理可以保证其安全、有效的医疗器械。第二类是具有中度风险，需要严格控制管理以保证其安全、有效的医疗器械。第三类（C错）是具有较高风险，需要采取特别措施严格控制管理以保证其安全、有效的医疗器械。